根据《中华人民共和国药品管理法》，经国家药品监督管理部门审核批准后方可销售的是
A. 药品外包装材料
B. 医院制剂
C. 未实施批准文号管理的中药饮片
D. 新发现和从国外引种的药材
E. 未实施批准文号管理的中药材

正确答案：D。新发现和从国外引种的药材

解析：本题考查药品经营管理。经国家药品监督管理部门审核批准后方可销售的是新发现和从国外引种的药材（D对）。《中华人民共和国药品管理法》第六十三条规定，新发现和从境外引种的药材，经国务院药品监督管理部门批准后，方可销售。